下列不是宫颈癌的危险因素的是
A. 病毒感染
B. 初次性交年龄过早
C. 患者配偶的性伴侣数过多
D. 多个性伴侣及性生活紊乱
E. 初潮年龄过早

正确答案：E。初潮年龄过早

解析：本题考查宫颈癌的危险因素。初潮年龄过早（E错，为本题正确答案）不是宫颈癌的危险因素。宫颈癌的危险因素：1.初次性交年龄过早（B对）；2.生育过早、过多、过密；3.多个性伴侣及性生活紊乱（D对）；4.社会学因素；5.病毒感染（A对）；6.男性有关的因素；7.吸烟；8.高危人群：患者配偶的性伴侣数过多（C对）。